患者精神抑郁，表情淡漠，神志痴呆，语无伦次，不思饮食，兼见不寐易惊，烦躁不安，舌红苔黄，脉滑数。治疗应首选
A. 顺气导痰汤
B. 生铁落饮
C. 黄连温胆汤加白金丸
D. 半夏厚朴汤
E. 四七汤加苏合香丸

正确答案：C。黄连温胆汤加白金丸

解析：患者精神抑郁，表情淡漠，神志痴呆，语无伦次，故诊断为癫证；本病常由于思虑太过，所求不得，肝气被郁，脾气不升，气郁痰结，阻蔽神明，故表现出精神抑郁，表情淡漠，神志痴呆，语无伦次这些精神异常的证候；痰浊中阻，故不思饮食；不寐易惊，烦躁不安，舌红苔黄，脉滑数，系痰气郁而化热，痰热交蒸，上扰心神所致，故其证候为痰气郁结证之痰郁化热，治以清热化痰，代表方为黄连温胆汤加白金丸（C对）。顺气导痰汤，其功用为涤痰开窍，与逍遥散合用，可用于治疗痰气郁结证（A错）。生铁落饮，其功用为清心泻火，涤痰醒神，适用于治疗狂证之痰火扰神证(B错)。半夏厚朴汤，其功用为行气开郁，降逆化痰，可用于治疗郁证之痰气郁结证（D错）。四七汤加苏合香丸，其功用为行气化痰，芳香开窍，可用于治疗痰气郁结证之痰迷心窍者（E错）。